下列关于点隙的特点中说法正确的是
A. 龋病的好发部位
B. 副沟相交形成凹陷的部位
C. 牙冠上不规则的凹陷部位
D. 二条或二条以上发育沟相交处的凹陷
E. 钙化不良形成的凹陷

正确答案：A。龋病的好发部位

解析：本题考查点隙。下列关于点隙的特点中说法正确的是龋病的好发部位（A对）。3条或3条以上发育沟的汇合处，或某些发育沟的末端所形成的点状凹陷称为点隙。此处牙釉质未完全连接，是龋病的好发部位。